不是桡动脉的分支的是
A. 桡侧返动脉
B. 掌浅支
C. 拇主要动脉
D. 骨间后动脉
E. 第1掌背动脉

正确答案：D。骨间后动脉

解析：桡侧返动脉（A对）、掌浅支（B对）、拇主要动脉（C对）、第1掌背动脉（E对）均为桡动脉的分支。骨间后动脉（D错，为本题正确答案）不是桡动脉的分支。